女，67岁，发作性胸骨闷痛4个月，近1周劳动耐量减小，发作频率高及疼痛时间增加来诊。最有助于确诊的检查是
A. 胸片
B. CT检查
C. 冠状动脉造影
D. 心电图
E. 心肌酶检查

正确答案：C。冠状动脉造影

解析：患者老年女性，发作性胸骨闷痛，劳动耐量减小，发作频率高及疼痛时间增加，考虑诊断为恶化型劳力性心绞痛（恶化型心绞痛）。心绞痛患者多由冠状动脉狭窄所致，冠状动脉造影（C对）可清楚的显示冠状动脉是否通畅，狭窄部位及狭窄程度等，是诊断冠心病心绞痛的金标准。胸片（A错）对心绞痛并无特异的诊断意义，仅有助于了解其他心肺疾病的情况，如有无心脏增大、充血性心力衰竭等。CT检查（B错）一般指多层螺旋CT冠状动脉成像（CTA），可判断冠脉管腔狭窄程度和管壁钙化情况，但其对狭窄程度的判断不如冠状动脉造影准确，故排除。发作时心电图可帮助诊断，大多数患者胸痛发作时有一过性ST段和T波改变。但心电图动态改变可随着心绞痛的缓解而完全或部分消失，故并非确诊最佳选择（D错）。心肌酶检查（E错）为心肌梗死后的特异性检查，心绞痛患者由于心肌并没有完全坏死，一般不会出现心肌酶的异常。